确诊系统性红斑狼疮最有价值的自身抗体是
A. ANA抗核抗体
B. 抗SSB抗体
C. 抗RNP抗体
D. 抗SSA抗体
E. 抗dsDNA抗体

正确答案：E。抗dsDNA抗体

解析：确诊系统性红斑狼疮最有价值的自身抗体是抗dsDNA抗体（E对），其特异性约95%，敏感性约70%，且抗体的滴度与疾病活动性密切相关。抗ANA抗体（A错）多用于SLE筛查，其敏感性约95%，特异性仅65%。抗SSB抗体（B错）在SLE阳性率仅10%～20%，抗SSA抗体（D错）在SLE阳性率仅30%～40%，以上两种抗体敏感性过低，对诊断SLE价值有限，阳性患者多合并干燥综合征、光敏感、血管炎、白细胞减少等症状。抗RNP抗体（C错）阳性率仅24%，敏感性过低，对诊断SLE价值有限。